青霉素钠注射剂的皮试药液浓度应为
A. 100U/ml
B. 250U/ml
C. 500U/ml
D. 750U/ml
E. 1000U/ml

正确答案：C。500U/ml

解析：本题考查皮试。青霉素钠注射剂的皮试药液浓度应为500U/ml（C对）。250U/ml（B错）（稀释20倍）为多价气性坏疽抗毒素注射剂的皮试药液浓度。